患有良性前列性增生症的老年患者服用抗过敏药后可致的严重不良反应是
A. 急性尿潴留
B. 严重高血压
C. 慢性荨麻疹
D. 急性胰腺炎
E. 血管性水肿

正确答案：A。急性尿潴留

解析：本题考查抗过敏药的使用。患有良性前列性增生症的老年患者服用抗过敏药后可致的严重不良反应是急性尿潴留（A对）。抗过敏药的不良反应常见头晕、嗜睡、口干恶心、倦乏、偶见皮疹和红细胞减少；长期应用达6个月以上可引起贫血，头痛、多汗、轻微胃肠不适以及心脏毒性；长期服用可增进食欲使体重增加；静注时全身热感，局部红肿等。但不包括严重高血压（B错）、急性胰腺炎（D错）、血管性水肿（E错）。慢性荨麻疹（C错）可用抗过敏药治疗。